制备速释固体分散物应首选的载体材料是
A. PLA
B. PVA
C. PVP
D. EC
E. HPMCP

正确答案：C。PVP

解析：本题考查制备速释固体分散体常用的载体材料。固体分散体常用的载体材料可分为水溶性、难溶性和肠溶性三大类，常用的水溶性载体材料有聚乙二醇（PEG）、聚乙烯吡咯烷酮（PVP）类（C对）、表面活性剂类、纤维素衍生物类、糖类与醇类、有机酸类等。聚乳酸（PLA）（A错）常用作缓释骨架材料、微囊囊膜材料和微球成球体材料。聚乙烯醇（PVA）（B错）常用作缓控释制剂中的增稠剂。乙基纤维素（EC）（D错）为缓释制剂的不溶性骨架材料。羟丙甲纤维素酞酸酯（HPMCP）（E错）为缓、控释制剂的肠溶性包衣材料。